阿司匹林的代谢产物中含有葡萄糖醛酸结合物，该代谢类型属于
A. 弱代谢作用
B. Ⅰ相代谢反应
C. 酶抑制作用
D. 酶诱导作用
E. Ⅱ相代谢反应

正确答案：E。Ⅱ相代谢反应

解析：本题考查Ⅱ相代谢反应。阿司匹林的代谢产物中含有葡萄糖醛酸结合物，该代谢类型属于Ⅱ相代谢反应（E对）。Ⅱ相代谢反应包括与葡萄醛酸的结合反应、与硫酸的结合反应、与氨基酸的结合反应、与谷胱甘肽的结合反应、乙酰化结合反应、甲基化结合反应。Ⅰ相代谢（B错）是药物的官能团转化反应，主要是药物结构中官能团在酶的催化下发生的氧化、还原、水解等生物转化反应。酶抑制作用（C错）是指抑制肝药酶活性，减慢其他药物的代谢速率。某些化学物质能提高肝药酶活性，增加自身或其他药物的代射速率，此现象称酶诱导。具有酶诱导作用的物质叫酶诱导剂。如苯巴比妥、苯妥英钠等有肝药酶诱导作用（D错），能加速药物的消除而使药效减弱。